右侧视束损伤可出现
A. 双眼视野颞侧偏盲
B. 双眼视野鼻侧偏盲
C. 右侧视野全盲
D. 双眼视野右侧同向性偏盲
E. 双眼视野左侧同向性偏盲

正确答案：E。双眼视野左侧同向性偏盲

解析：当视觉传导通路的不同部位受损时，可引起不同的视野缺损： 视网膜损伤引起的视野缺损与损伤的位置和范围有关； 一侧视神经损伤可致该侧眼视野全盲（C错）； 视交叉中交叉纤维损伤可致双眼视野颞侧半偏盲（A错）； 一侧视交叉外侧部的不交叉纤维损伤，则患侧眼视野的鼻侧半偏盲（B错）；一侧视束及以后的视觉传导路（视辐射、视区皮质）受损，可致双眼病灶对侧半视野同向性偏盲（如右侧受损则右眼视野鼻侧半和左眼视野颞侧半偏盲）（D错E对）。